病毒性肝炎肝细胞气球样变
A. 细胞水肿
B. 玻璃样变
C. 粘液变性
D. 淀粉样变
E. 脂肪沉积(脂肪变性）

正确答案：A。细胞水肿

解析：细胞水肿（A对）由于细胞容积和胞质离子浓度调节机制功能下降，胞内水钠聚集增多时，细胞肿大明显，呈气球样变，如病毒性肝炎。玻璃样变（B错）是指细胞内或间质中出现半透明状蛋白质蓄积，常发生于细胞内，纤维结缔组织和细小动脉壁。粘液样变（C错）是指细胞间质内粘多糖和蛋白质的蓄积，甲状腺功能低下使，可形成特征性水肿。淀粉样变（D错）是细胞间质内淀粉样蛋白质和黏多糖复合物蓄积，常发生于皮肤、结膜、舌、喉和肺等处。脂肪沉淀（E错）指甘油三酯蓄积于非脂肪细胞的细胞质中，多发生于肝细胞（酒精中毒），心肌细胞和肾小管上皮细胞等。